女性，35岁，颈前区肿块10年，近年来易出汗、心悸，渐感呼吸困难。体检：晨起心率104次/分，BP120/60mmHg，无突眼，甲状腺Ⅲ度肿大，结节状，心电图示：窦性心率不齐。初步诊断最可能的是
A. 原发性甲亢
B. 单纯性甲状腺肿
C. 继发性甲亢
D. 桥本甲状腺炎
E. 亚急性甲状腺炎

正确答案：C。继发性甲亢

解析：青年女性患者，颈前区肿块10年（单纯性甲状腺肿病程久，常出现结节性甲状腺肿），近年来易出汗、心悸，渐感呼吸困难（甲亢的典型临床表现）。体查：晨起心率104次/分（脉率增快），BP120/60mmHg（脉压增大，正常值约30～40mmHg），无突眼，甲状腺Ⅲ度肿大，结节状（存在结节性甲状腺肿大）。心电图示：窦性心率不齐（提示存在心肌损害）。综合该患者的病史、体查、心电图检查，初步诊断最可能的是继发性甲亢（C对）。原发性甲亢（A错）表现为甲状腺弥漫性对称性肿大，常伴有眼球突出，同时出现神经、循环、消化等系统兴奋性提高和代谢亢进。单纯性甲状腺肿（P226）（B错）表现为甲状腺对称性、弥漫性肿大，腺体表面光滑，一般无甲状腺功能亢进的症状。桥本甲状腺炎（P231）（D错）表现为无痛性弥漫性甲状腺肿，对称，质硬，表面光滑，多伴甲状腺功能减退。亚急性甲状腺炎（P230）（E错）表现为甲状腺突然肿胀、发硬、吞咽困难及疼痛，并向患侧耳颞处放射，常始于甲状腺一侧，并很快向腺体其他部位扩展。